可用阿托品治疗的疾病有
A. 有机磷中毒
B. 内脏绞痛
C. 青光眼
D. 感染中毒休克
E. 心房纤颤

正确答案：A、B、D。有机磷中毒；内脏绞痛；感染中毒休克

解析：本题考查阿托品的作用。可用阿托品治疗有机磷中毒（A对）、内脏绞痛（B对）、感染中毒休克（D对）；阿托品用于心房纤颤（E错）时效果不明显；阿托品对眼的作用为扩瞳、升高眼内压，禁用青光眼（C错）。